人参中化学成分主要结构为
A. 人参皂苷二醇型
B. 齐墩果酸型
C. 苄基异喹啉类
D. 人参皂苷三醇型
E. 原小檗碱型

正确答案：A、B、D。人参皂苷二醇型；齐墩果酸型；人参皂苷三醇型

解析：本题考查的是人参化学成分的结构与分类。人参中化学成分主要结构为人参皂苷二醇型（A对）、人参皂苷三醇型（B对）和齐墩果烷型（D对）。人参含有皂苷、多糖和挥发油等多种化学成分，人参皂苷为人参的主要有效成分之一。《中国药典》以人参皂苷为指标成分对人参、红参和人参叶进行含量测定。其中，人参和红参的质量控制成分为人参皂苷Rg₁、人参皂苷Re和人参皂苷Rb₁。例如，要求人参中人参皂苷Rg₁和人参皂苷Re的总量不得少于0.30%，人参皂苷Rb₁不得少于0.20%。人参皂苷可以分为三类，分别是人参皂苷二醇型（A型）、人参皂苷三醇型（B型）和齐墩果烷型（C型）。苄基异喹啉类（C错）分为1-苄基异喹啉类和双苄基异喹啉类。①1-苄基异喹啉类：为异喹啉母核1位连有苄基的一类生物碱。如罂粟中具解痉作用的罂粟碱，乌头中的强心成分去甲乌药碱，厚朴中的厚朴碱等。②双苄基异喹啉类：为两个苄基异喹啉通过1～3个醚键相连接的一类生物碱。如存在于防己科北豆根中的主要酚性生物碱蝙蝠葛碱，汉防己中的汉防己甲素和汉防己乙素，十大功劳中的异汉防己甲素。原小檗碱型（E错）生物碱可以看成由两个异喹啉环稠合而成。依据两者结构母核中D环氧化程度不同，又分为小檗碱类和原小檗碱类。前者多为季胺碱，如黄连、黄柏、三颗针中的小檗碱；后者多为叔胺碱，如延胡索中的延胡索乙素。